下列关于慢性病的防控措施叙述错误的是
A. 建立支持性的环境
B. 主要针对不可改变的危险因素
C. 提高个体的健康素养
D. 提供有效的临床预防服务
E. 提供有效的疾病管理

正确答案：B。主要针对不可改变的危险因素